有关慢性毒作用带的概念，错误的是
A. 慢性毒作用带（Zch）是危害性指标
B. Zch=急性阈剂量/慢性阈剂量
C. Zch大表示此外源性化合物不易引起慢性毒性
D. 对于毒作用有阈值的外源性化合物可求得Zch
E. 在制订安全限值（最高容许浓度）时可参考Zch来确定安全系数

正确答案：C。Zch大表示此外源性化合物不易引起慢性毒性